X线片上牙槽嵴顶到釉牙骨质界的距离超过多少mm
A. 1mm
B. 2mm
C. 3mm
D. 4mm
E. 5mm

正确答案：A。1mm

解析：本题考查牙槽骨。X线片上牙槽嵴顶到釉牙骨质界的距离超过1mm（A对）。牙槽骨的最冠方，即邻近牙颈部处称为牙槽嵴顶。牙槽嵴顶和釉牙骨质界的距离在青年人约0.75～1.49mm，平均1.08mm。在X线（牙合）翼片上，牙槽嵴顶到釉牙骨质界的距离为0.62～1.67mm，平均1.15mm。一般认为此距离＜2mm均为正常。